70岁震颤麻痹患者最有效的治疗药物是
A. 溴隐亭
B. 金刚烷胺
C. 复方左旋多巴
D. 丙炔苯丙胺
E. 卡马西平

正确答案：C。复方左旋多巴

解析：震颤麻痹即帕金森病。帕金森的主要病变为黑质多巴胺能神经元显著变性丢失、黑质-纹状体多巴胺能通路变性，导致纹状体多巴胺递质水平显著降低，因此应用复方左旋多巴的替代治疗是最有效的治疗方法，但老年前患者（＜65岁）因考虑长期的治疗效果，不能首选复方左旋多巴的替代治疗。本题中患者已70岁，其首选及最有效的药物为复方左旋多巴（C对）。溴隐亭（A错）、金刚烷胺（B错）、丙炔苯丙胺（D错）均是帕金森患者的治疗药物，但不是最有效的药物。卡马西平（E错）为抗癫痫药，对帕金森的治疗没有作用。